登革病毒的传播方式是经
A. 呼吸道传播
B. 虫媒传播
C. 性接触传播
D. 消化道传播
E. 血液传播

正确答案：B。虫媒传播

解析：登革病毒是登革热、登革出血热（登革休克综合征）的病原体，人类和灵长类动物是登革病毒的自然宿主，埃及伊蚊和白纹伊蚊是登革病毒的主要传播媒介，因此登革病毒的传播方式为虫媒传播（B对）。呼吸道传播（A错）是流感病毒、鼻病毒、腺病毒等的传播方式；性接触传播（C错）是HIV、疱疹病毒、乳头瘤病毒等的传播方式的是；消化道传播（D错）是脊髓灰质炎病毒、轮状病毒、新型肠道病毒等的传播方式；血液传播（E错）是乙型肝炎病毒、丙型肝炎病毒、巨细胞病毒等的传播方式（P221表23-1）。